镜下可见上皮变性坏死，并有大量念珠菌的菌丝及孢子，且病变可见白色斑膜，为以下哪一类型的念珠菌病
A. 肉芽肿型
B. 颗粒型
C. 慢性萎缩型
D. 急性假膜型
E. 慢性增生型

正确答案：D。急性假膜型

解析：急性假膜型念珠菌病白色斑膜；镜下见上皮变性坏死，并有大量菌丝及孢子。掌握“口腔念珠菌病与肉芽肿性唇炎”知识点。